下列哪项不是苯胺中毒的临床表现
A. 高铁血红蛋白血症
B. 溶血性贫血
C. 中毒性多发性神经炎
D. 赫恩氏小体
E. 膀胱刺激症状

正确答案：C。中毒性多发性神经炎